关于福辛普利性质描述正确是
A. 福辛普利是含有巯基的ACE抑制剂
B. 福辛普利是含有膦酰基的ACE抑制剂
C. 福辛普利在体内代谢为福辛普利拉而发挥作用
D. 福辛普利在体内可经肝或肾“双通道”代谢
E. 福辛普利是含有二羧基的ACE抑制剂

正确答案：B、C、D。福辛普利是含有膦酰基的ACE抑制剂；福辛普利在体内代谢为福辛普利拉而发挥作用；福辛普利在体内可经肝或肾“双通道”代谢

解析：本题考查福辛普利。福辛普利是含有膦酰基的ACE抑制剂的代表（B对AE错）。福辛普利为前体药，在体内代谢为福辛普利拉后药效增强（C对）。福辛普利部分为肝肾“双通道”代谢（D对）。